朊粒引起的疾病不包括
A. 库鲁病
B. 羊瘙痒症
C. 克-雅病
D. 亚急性硬化性全脑炎
E. 牛海绵状脑病（疯牛病）

正确答案：D。亚急性硬化性全脑炎

解析：本题考查朊粒引起的疾病。亚急性硬化性全脑炎（D错，为本题的正确答案）是急性麻疹病毒感染的迟发并发症，表现为渐进性大脑衰退，一般在1～2年内死亡。朊粒引起的疾病包括：1.人类朊粒病：库鲁病（A对）、克-雅病（CJD）（C对）、格斯特曼综合征（GSS）、致死性家族失眠症（FFI）等；2.动物朊粒病：羊瘙痒病（B对）、水貂传染性脑病（TME）、鹿慢性消瘦症（CWD）、牛海绵状脑病（疯牛病，BSE）（E对）、猫海绵体脑病（FSE）等。